杀灭红细胞内疟原虫配子体和迟发型子孢子的药物是
A. 氯喹
B. 卡巴胂
C. 磷酸伯氨喹
D. 甲硝唑
E. 吐根碱

正确答案：C。磷酸伯氨喹

解析：杀灭红细胞内疟原虫配子体和迟发型子孢子的药物是磷酸伯氨喹（C对）。氯喹（A错）主要用于氯喹敏感的疟原虫感染治疗。卡巴胂（B错）是一种人工合成的五价胂剂，能抑制虫体2巯基酶活性，能直接杀灭阿米巴滋养体。甲硝唑（D错）用于治疗肠道和肠外阿米巴病和厌氧菌的治疗。吐根碱（E错）的盐酸盐对溶组织阿米巴滋养体有直接杀灭作用，可用于治疗急性阿米巴病。